下列按伤情分类属于重伤的是
A. 肱骨骨折
B. 股骨干骨折合并肺脂肪栓塞
C. 脾被膜下破裂
D. 开放性胫腓骨骨折
E. 膀胱破裂

正确答案：B。股骨干骨折合并肺脂肪栓塞

解析：根据《人体损伤程度鉴定标准》，股骨干骨折合并肺脂肪栓塞（B对）按伤情分类属于重伤。肱骨骨折（A错）、开放性胫腓骨骨折（D错）按伤情分类属于轻伤。脾被膜破裂（C错）、膀胱破裂（E错）伤情分类属于轻伤一级。